7个月男孩，确诊川崎病后，经治疗症状缓解出院，2个月后无明显诱因猝死家中，其死因最可能是
A. 冠状动脉瘤破裂
B. 心包炎
C. 脑栓塞
D. 心肌炎
E. 颅内出血

正确答案：A。冠状动脉瘤破裂

解析：川崎病大中小动脉均可累及，中等动脉尤以冠状动脉病变最严重，冠状动脉损害多发生于病程第2～4周，但也可发生于疾病恢复期。心肌梗死和冠状动脉瘤破裂可致心源性休克，甚至猝死。掌握“川崎病”知识点。